患者，女，26岁，已婚。分娩时失血较多，产后小腹隐隐作痛，喜按，恶露量少、色淡，头晕耳鸣，大便干燥，舌淡苔薄，脉虚细。应首先考虑的是
A. 产后血晕
B. 产后腹痛
C. 产后大便不通
D. 产后恶露过少
E. 以上均非

正确答案：B。产后腹痛

解析：患者分娩时失血较多，气血两虚，并伴有产后小腹隐隐作痛，喜按，恶露量少，头晕耳鸣但无眼花不能起坐，大便干燥但无不通（B对）。产后血晕多表现为头晕眼花，不能起坐，或心胸满闷，恶心呕吐，痰涌气急，心烦不安，甚则神昏口噤，不省人事（A错）。产后大便不通多表现为腹胀，胀气大便不下，食欲不振，按揉腹部有质硬结节（C错）。产后恶露过少表现为恶露量少或无，多因产后失血气血两虚所引起，不伴有产后腹痛隐隐的症状（D错）。